男性，35岁。右肾疼痛，尿常规红细胞充满视野，白细胞2-3个/HP，尿路平片可见右下段输尿管走行区高密度阴影0.6cm，IVU可见右输尿管下段结石，其上输尿管轻度扩张，右肾轻度积水。对该患者应采取哪种治疗方法
A. 膀胱切开取石术
B. 套石术
C. 药物排石
D. 大量饮水等待自然排出
E. 体外震波碎石

正确答案：B。套石术

解析：患者右下段输尿管结石，尿路平片示结石直径0.6cm；右上输尿管扩张轻度扩张、右肾轻度积水，提示患者远端尿路梗阻症状；尿常规示白细胞2～3个/HP（正常值0～5个/HP），提示患者无尿路感染，故此时对该患者应行输尿管镜碎石取石术，又叫套石术（B对），结石＜0.6cm、表面光滑、结石以下尿路无梗阻时可采用大量饮水可选用药物排石（C错）或其他非手术治疗措施。对于膀胱结石＞3cm的感染严重的患者，常采用膀胱切开取石术（A错）。体外震波碎石（E错）适用于直径＜2cm的肾结石及输尿管上段结石。大量饮水等待自然排出（D错）适用于结石小且无梗阻的情况。